消渴的病变脏腑主要是
A. 肺、脾、肾
B. 肺、胃、肾
C. 心、肝、肾
D. 肝、脾、肾
E. 脾、胃、肾

正确答案：B。肺、胃、肾

解析：消渴的病变脏腑主要在肺、胃、肾（B对），尤以肾为关键。三脏之中，虽有偏重，但互相影响。